男，44岁。胃癌根治术后第6天，出现上腹剧烈疼痛，逐渐加重，伴恶心、呕吐、腹胀。查体腹膜刺激征（+），腹腔引流管引流出咖啡色浑浊液体。腹部B超提示腹腔积液。最可能的诊断是
A. 急性梗阻性化脓性胆管炎
B. 肠系膜血管缺血性疾病
C. 急性胆囊炎
D. 吻合口瘘
E. 急性胰腺炎

正确答案：D。吻合口瘘

解析：青年男性患者，胃癌根治术后6天出现上腹剧烈疼痛、恶心、呕吐、腹胀，腹膜刺激征阳性，腹腔引流引出咖啡色样浑浊液体，最可能的诊断是吻合口瘘（D对）。急性梗阻性化脓性胆管炎（P445）（A错）发病急骤，主要表现为腹痛、寒战高热、黄疸、休克及神经中枢系统受抑制表现（Reynolds五联征），一般无腹腔积液等表现。肠系膜血管缺血性疾病（P365）（B错）一般发病急骤，主要表现为突发剧烈腹部绞痛、恶心、呕吐，呕吐物多为血性，腹部体征轻微，与严重的症状不相称。急性胆囊炎（P443）（C错）多见于女性，患者多有胆囊结石病史，常表现为饱餐、进食肥腻食物后上腹部疼痛、恶心、呕吐，腹痛可放射至右肩、肩胛和背部，查体可有右上腹局部压痛、反跳痛，Murphy征阳性，无腹腔积液表现。急性胰腺炎（P457）（E错）常于饱餐和饮酒后突然发作，腹痛多位于左上腹，向左肩及左腰背部放射。